医生对于绝经后妇女注射雌激素，用于预防骨质疏松的发生，属于
A. 化学预防
B. 筛查
C. 健康咨询
D. 免疫接种
E. 药物治疗

正确答案：A。化学预防

解析：对绝经期妇女注射雌激素预防骨质疏松的发生符合化学预防（A对），化学预防指对无症状者使用药物、营养素（包括矿物质）、生物制剂或其他天然物质作为第一级预防措施，提高人群抵抗疾病的能力，防止某些疾病的发生。筛查（B错）指运用快速简便的测试、体格或实验室检查等方法，在健康人群或“无症状”患者中发现未被识别的可疑患者、健康缺陷者及高危个体的一项预防措施（P134）。健康咨询（C错）是通过收集就医者的健康危险因素，对个体进行有针对性的健康教育，提高就医者自我保健意识，并与就医者共同制定改变不良健康行为的计划，督促就医者执行干预计划等，促使他们自觉地采纳有益于健康的行为，消除或减轻影响健康的危险因素，比如戒烟，控制体重等（P134）。 免疫接种（D错）是指用人工制备的疫苗类制剂（特异性抗原）或免疫血清制剂（特异性抗体），通过适当的途径接种到机体，使人体或群体产生对某种传染病的自动免疫或被动免疫，从而保护易感人（P135）。预防性治疗（E错）指通过应用一些治疗的手段，预防某一疾病从一个阶段进展到更为严重阶段，或预防从某一较轻疾病发展为另一较为严重疾病的方法群（P135）。